用于缓解鼻塞的α-受体激动剂禁用的人群是
A. 糖尿病患者
B. 血脂异常患者
C. 慢性阻塞性肺病患者
D. 肾衰竭患者
E. 高血压患者

正确答案：E。高血压患者

解析：本题考查药物的禁忌症。α-受体激动剂即肾上腺素受体激动剂，对儿童、高血压（E对）、前列腺增生症、癫痫、闭角型青光眼、幽门梗阻、膀胱颈梗阻、鼻腔干燥和萎缩性鼻炎、甲状腺功能亢进患者、妊娠及哺乳期妇女禁用；对糖尿病、冠心病患者慎用。